男，70岁，因观看足球比赛突然晕倒而入院治疗。查体发现左侧上下肢瘫痪，腱反射亢进，左侧眼裂以下面瘫，伸舌时舌尖偏向左侧。左半身深浅感觉消失。双眼左侧半视野缺失，瞳孔对光反射存在。考虑病变的部位在
A. 左侧中央前后回
B. 右侧中央前回
C. 左侧内囊
D. 右侧内囊
E. 右侧中央后回

正确答案：D。右侧内囊

解析：患者老年男性，情绪激动情况下突然晕倒，查体发现左侧上下肢瘫痪，腱反射亢进，左侧眼裂以下面瘫，伸舌时舌尖偏向左侧（偏瘫），左半身深浅感觉消失（偏身感觉障碍），双眼左侧半视野缺失（偏盲），瞳孔对光反射存在。出现典型的左侧“三偏”综合征，因为“三偏症”的症状出现在病灶对侧，故此处定位诊断为右侧内囊（D对C错）完全性损害，定性诊断为脑出血。右侧中央前回（B错）损害刺激性病变表现为左侧上下肢或面部抽搐（Jackson癫痫）或继发全身性的癫痫；破坏性病变多引起单瘫，均无偏盲表现（P007）。右侧中央后回（E错）损害破坏性病变表现为左侧肢体复合性感觉障碍；刺激性病变表现为左侧肢体的部分性感觉性癫痫，均无偏盲表现（P007）。左侧中央前后回（A错）损害的表现应为中央前回与中央后回损害的表现的总和，且无偏盲表现。